一年级200人，12岁患龋率20%，龋均1。二年级200人，13岁患龋率22.5%，龋均1.5。三年级100人，14岁患龋率25%，龋均2。全年级龋均
A. 1.3
B. 1.4
C. 1.5
D. 1.6
E. 1.7

正确答案：B。1.4

解析：本题考查龋均的计算。一年级200人，12岁患龋率20%，龋均1。二年级200人，13岁患龋率22.5%，龋均1.5。三年级100人，14岁患龋率25%，龋均2。龋均=龋、失、补牙数之和/受检人数，一年龋、失、补牙数之和为200；二年级为300；三年级为200。因此，全年级龋均=（200+300+200）/（200+200+100）=1.4（B对）。